少数翼下颌间隙感染来源于
A. 牙源性
B. 血源性
C. 损伤性
D. 腺源性
E. 医源性

正确答案：E。医源性

解析：本题考查翼下颌间隙感染的感染来源。少数翼下颌间隙感染来源于医源性（E对）。翼下颌间隙感染多来自下颌智牙冠周炎及下颌磨牙根尖周炎症扩散所致，牙源性为常见感染途径（A错）。血源性（B错）、损伤性（C错）、腺源性（D错）感染途径不常见。